测量一物体长短，如果用钢尺量，则几次量的结果是一样的；但如果用松紧带测量，则可能有时量长，有时量短。反映工具可靠性和稳定性的标准化心理测验的技术指标是
A. 效度
B. 信度
C. 常模
D. 测量误差
E. 常量

正确答案：B。信度

解析：本题考查信度。测量一物体长短，如果用钢尺量，则几次量的结果是一样的；但如果用松紧带测量，则可能有时量长，有时量短。反映工具可靠性和稳定性的标准化心理测验的技术指标是信度（B对）。（1）信度是指用同一指标重复测量某项稳定特质时得到相同结果的程度。信度的同义词是一致性、可重复性。信度通常用信度系数来表示，信度系数越大，表明问卷调查结果的可靠性越高。（2）效度（A错）就是正确性程度，即在多大程度上反映了想要测量的概念的真实含义。效度越高，表示测量结果越能显示测量对象的真正特征，效度也称为有效性、准确性或真实性。良好的效度是任何测量工具所必备的条件。检验效度的方法有内容效度、准则效度和建构效度等。（3）常模（C错）是一种供比较的标准量数，由标准化样本测试结果计算而来，即某一标准化样本的平均数和标准差。它是人才测评用于比较和解释测验结果时的参照分数标准。测验分数必须与某种标准比较，才能显示出它所代表的意义。常模的构成要素为：原始分数；导出分数；对常模团体的有关具体描述。（4）在测量时，测量结果与实际值之间的差值叫误差。真实值或称真值是客观存在的，是在一定时间及空间条件下体现事物的真实数值，但很难确切表达。测得值是测量所得的结果。这两者之间总是或多或少存在一定的差异，就是测量误差（D错）。测量误差主要分为三大类：系统误差、随机误差、粗大误差。（5）变量和常量都是统计学研究中的对象特征，在数量指标中，不变的数量指标称为常量（E错）或参数，可变的数量指标称为变量。